下述下颌切牙与上颌切牙区别中哪个不正确
A. 下颌切牙牙冠较窄小
B. 下颌切牙牙冠唇面较光滑
C. 下颌切牙牙根窄而扁
D. 下颌切牙的切嵴靠近牙体长轴
E. 下颌切牙舌面边缘嵴明显，舌窝较浅

正确答案：E。下颌切牙舌面边缘嵴明显，舌窝较浅

解析：本题考查下颌切牙与上颌切牙的区别。下颌切牙舌面边缘嵴不明显，舌窝较浅（E错，为本题的正确答案），而上颌切牙的舌窝较深，舌面边缘嵴明显。切牙包括上颌切牙和下颌切牙。上颌切牙较下颌切牙牙冠宽大，唇面发育沟明显，而下颌切牙牙冠较窄小（A对），唇面较光滑（B对），发育沟不明显。上颌切牙牙根直而粗壮，下颌切牙牙根窄而扁（C对），近远中面凹陷成沟状，牙根中部横切面似葫芦形。从邻面观察，下颌切牙的切嵴靠近牙体长轴（D对）而上颌切牙的切嵴位于牙体长轴的唇侧。